提倡“内伤积损”为中风病病机实质的是下列哪一位医家
A. 王履
B. 张仲景
C. 李东垣
D. 张景岳
E. 李中梓

正确答案：D。张景岳

解析：中风病，张仲景（B错）《金匮要略》认为中风之病是由于络脉空虚，风邪乘虚入中，并以中邪浅深、病情轻重分为中经中络、中脏中腑。唐宋以后，特别是金元时期，突出以“内风”立论，可谓中风病因学说上的一大转折。如刘河间力主“心火暴盛”；李东垣（C错）认为“正气自虚”；朱丹溪主张“湿痰生热”；王履（A错）从病因学角度归类提出“真中风”与“类中风”的病名，其中因于风而发者称为真中风，因于火、因于气、因于湿而发病者称为类中风而非中风。明代医家张景岳（D对）倡导“非风”之说，认为本病的发生系“内伤积损”而非“外感风寒”所致的论点。李中梓（E错）又将中风分为闭、脱二证。